判断小儿支气管肺炎严重程度的指标是
A. 白细胞高低
B. 呼吸频率
C. 有无累及其他系统
D. 胸片显示程度
E. 感染菌群

正确答案：C。有无累及其他系统

解析：有无累及其他系统（C对）是小儿支气管肺炎严重程度的指标。支气管肺炎白细胞会因感染菌群的不同而出现变化，但白细胞高低（A错）对小儿支气管肺炎严重程度并没有大多的参考作用。支气管肺炎的严重程度与小儿机体免疫力、感染菌群毒力都有联系，单一的感染菌群（E错）毒力并不是判断小儿支气管肺炎严重程度的指标。呼吸频率（B错）是小儿在支气管肺炎出现呼吸窘迫诊断的参考指标，并不能判断严重程度。胸片显示程度（D错）能反映支气管肺炎所累及肺的范围，对小儿支气管肺炎严重程度有一定的参考价值，但不是明确判断小儿支气管肺炎的指标。